具有主神明生理特性的脏是
A. 肝
B. 心
C. 脾
D. 肺
E. 肾

正确答案：B。心

解析：本题考查脏腑的生理特性，属于理解记忆内容。心的生理特性是：为阳脏而主通明。心主通明，通即通畅，明即清明。是指心脉以通畅为本，心神以清明为要（B对）。